初期复苏的任务和步骤可归纳为ABC，其含义是
A. 触大动脉确诊→进行人工呼吸→建立人工循环
B. 保持呼吸道通畅→进行人工呼吸→建立人工循环
C. 保持呼吸道通畅→建立人工循环→进行人工呼吸
D. 心肺复苏→药物治疗→脑复苏
E. 低温→脱水→皮质激素治疗

正确答案：B。保持呼吸道通畅→进行人工呼吸→建立人工循环

解析：心肺复苏中A（airway）是指及时开放气道，保持呼吸顺畅；B（Breath）是指及时进行人工呼吸；C（circulation）是指实施人工血压循环，即及时实施胸外心脏按压。综上，ABC的含义为保持呼吸道通畅→进行人工呼吸→建立人工循环（B对）。2010年AHA复苏指南已将成人心肺复苏的顺序由A-B-C改为C-A-B，即建立人工循环→保持呼吸道通畅→进行人工呼吸，按最新观点本题无正确答案。